男，20岁。右前臂被炸伤4小时，最大伤口长5cm，出血多，伤及肌肉，X线检查无骨折、未见金属异物。其伤口最佳处理是
A. 清创后二期缝合
B. 加压包扎、止血观察
C. 清洗伤口后包扎
D. 包扎，石膏固定患肢
E. 清创后一期缝合

正确答案：A。清创后二期缝合

解析：该患者右前臂被炸伤，为火器伤，虽然受伤时间仅为4小时，但治疗时清创后不宜一期缝合（E错），因为初期清创后，挫伤区和震荡区参差交错，不易判断。火器伤无论伤后多长时间，除颜面伤、头皮伤、关节伤等损伤外，一律清创后开放引流+延期缝合，即清创后二期缝合（A对）。加压包扎止血观察（B错）、清洗伤口后包扎（C错）、包扎后石膏固定患肢（D错）均为现场急救措施，不是火器伤伤口的最佳处理措施。